下列不是肺结核患者的典型症状的是
A. 倦怠、乏力
B. 低热
C. 打喷嚏
D. 夜间盗汗、食欲减退
E. 咳嗽

正确答案：C。打喷嚏

解析：本题考查肺结核患者的典型症状。肺结核患者的典型症状有倦怠、乏力（A对）、低热（B对）、食欲减退、盗汗（D对）、咳嗽（E对）、咳痰、胸痛、咯血、消瘦和月经不调等。打喷嚏（C错，为本题正确答案）不是肺结核患者的典型症状。